扩张型心肌病最主要的临床表现为
A. 充血性心力衰竭
B. 猝死
C. 栓塞
D. 食欲不振
E. 肺部感染

正确答案：A。充血性心力衰竭

解析：扩张型心脏病是一类以左心室或双心室扩大伴收缩功能障碍为特征的心肌病。由于心室腔扩大并伴收缩功能下降，导致循环血液回流障碍，而出现体循环和（或）肺循环淤血，因此临床表现主要为充血性心力衰竭（A对）。扩张型心肌病合并心律失常时可出现猝死（B错）；如果心室或者心腔血流缓慢，血液中的有形物质（红细胞和血小板等）就会沉积下来，形成附壁血栓，其可脱落导致栓塞（C错）。右心衰竭引起胃肠道淤血时可出现食欲不振（D错）。扩张型心肌病一般少见肺部感染（E错）。